肺的静态顺应性越大，表示
A. 肺的弹性阻力大，肺扩张程度小
B. 肺的弹性阻力小，肺扩张程度小
C. 肺的非弹性阻力大，肺扩张程度大
D. 肺的弹性阻力小，肺扩张程度大
E. 肺的非弹性阻力与肺扩张程度无变化

正确答案：D。肺的弹性阻力小，肺扩张程度大